伴有高血压的患者应慎用的是
A. 对乙酰氨基酚
B. 氯苯那敏
C. 含伪麻黄碱的复方制剂
D. 阿司匹林
E. 含可待因的复方制剂

正确答案：C。含伪麻黄碱的复方制剂

解析：本题考查药物的不良反应。伪麻黄碱（C对）可引起血管收缩，造成血压升高，因此高血压患者应慎用。可待因（E错）为国家管理的麻醉药，反复用药可引起药物依赖性。对乙酰氨基酚（A错）少数病人使用后可发生过敏性皮炎(皮疹、皮肤瘙痒等）、粒细胞缺乏、血小板减少、高铁血红蛋白血症、贫血及肝、肾功能损害等。氯苯那敏（B错）不良反应较轻。可有胸闷、咽喉痛、疲劳、虚弱感、心悸或皮肤瘀斑、出血倾向，但皆很少见。阿司匹林（D错）妊娠期妇女避免使用。